在流行病学调查中能够表现调查对象的基本特征的是
A. 口腔健康行为
B. 口腔健康知识
C. 口腔健康相关生活质量
D. 口腔健康态度
E. 研究对象的属性

正确答案：E。研究对象的属性

解析：研究对象的属性：即调查对象的基本特征，包括反映一个人社会人口学特征的年龄、性别、种族、婚姻状况、居住地等的信息和反映一个人社会经济特征的受教育程度、职业、收入等信息。掌握“口腔健康问卷调查”知识点。